男性，19岁，患病1周。牙龈乳头坏死，前牙唇侧明显，坏死形成溃疡处凹陷，表面灰白色假膜，触之出血明显，口腔有腐败性口臭。体温37.8℃，颏下淋巴结肿痛。既往未出现全身明显异常现象。有辅助诊断意义的检查是
A. 白细胞分类
B. 脱落细胞检查
C. 细菌学检查
D. X线片
E. 组织病理

正确答案：C。细菌学检查

解析：本题考查坏死性溃疡性龈炎。细菌学检查：病变区坏死物涂片，进行瑞氏（Wright）染色，或刚果红染色，在显微镜下观察有无梭形杆菌和螺旋体。细菌学检查（C对）只是作为辅助检查方法。